窝洞制备过程中，三壁相交构成
A. 点角
B. 线角
C. 洞面角
D. 颊轴龈点角
E. 颊髓线角

正确答案：A。点角

解析：洞侧壁与牙面相交形成的线角，即洞缘角或洞面角。内壁与内壁相交处，形成洞角。洞角分线角和点角。两壁相交构成线角，三壁相交构成点角。如舌轴龈点角，颊轴龈点角（颊壁，轴壁，龈壁构成的）。两壁相交构成线角，颊壁与髓壁构成的线角叫颊髓线角。掌握“银汞充填窝洞的概念”知识点。